服用后不要立即饮水的药品包括
A. 氨茶碱
B. 硫糖铝
C. 丙磺舒
D. 川贝止咳糖浆
E. 胶体果胶铋

正确答案：B、D、E。硫糖铝；川贝止咳糖浆；胶体果胶铋

解析：本题考查限制饮水的药物。硫糖铝（B对）、川贝止咳糖浆（D对）、胶体果胶铋（E对）均为服用后不要立即饮水的药品。硫糖铝、果胶铋为胃黏膜保护剂，服药后在胃中形成保护膜，服药后1小时内尽量不要饮水，以避免保护层被水冲掉。止咳糖浆会黏附在发炎的咽喉部而发挥药理作用，用后应少饮水。氨茶碱（A错）、丙磺舒（C错）均为服用后宜多饮水的药物。